一般来说，医患之间信托-契约关系所倡导的医患交往模式是
A. 双方冲突型
B. 患者主导型
C. 主动-被动型
D. 指导-合作型
E. 共同参与型

正确答案：D。指导-合作型

解析：指导-合作模式：患者作为有意识、有思想的人，具有一定的主动性，能够主动述说病情，反应诊治情况，配合检查和治疗。但对医生诊治措施既提不出异议，也提不出反对意见，医生仍具有权威性，仍居于主导地位。这种模式使用与大多数患者，而且有助于发挥患者的积极性，提高诊治效果，也是较普遍采用的一种模式。掌握“医患关系伦理”知识点。